位于上颌硬区的两侧用于连接前、后腭杆的
A. 前腭板
B. “天窗”式腭板
C. 前腭杆
D. 后腭杆
E. 侧腭杆

正确答案：E。侧腭杆

解析：侧腭杆：位于上颌硬区的两侧，离开龈缘应有4～6mm，并且与牙弓平行，用于连接前、后腭杆，一侧或两侧（双杆）均可。其强度好，不易变形，戴用舒适。掌握“局部义齿连接体”知识点。